患儿，1岁半，夜间烦吵，多汗半年余。查体：前囟2cm×2cm，方颅，肋串珠明显血钙磷乘积下降，碱性磷酸酶升高。其诊断是
A. 佝偻病活动初期
B. 佝偻病激期
C. 佝偻病恢复期
D. 佝偻病后遗症期
E. 健康儿童

正确答案：B。佝偻病激期

解析：患儿现症见方颅，肋串珠明显血钙磷沉积下降，碱性磷酸酶升高，诊断为佝偻病激期。顶骨与额骨双侧骨样组织增生，形成方颅。维生素 D缺乏造成肠道钙、磷吸收减少，血钙降低（B对E错）。佝偻病活动初期主要表现为神经兴奋性增高，如有烦躁、睡眠不安、易惊、夜啼、多汗等症，并可致枕部脱发而见枕秃。血生化改变轻微，血清-（OH）3D，下降，PTH增高、血钙正常或略下降，血磷降低，碱性磷酸酶正常或稍高，骨骼X 线摄片可无异常，或见临时钙化带稍模糊（A错）。恢复期：初期或激期患儿经日光照射或足量维生素 D治疗后，临床症状和体征逐渐减轻、消失，血生化逐渐恢复正常，骨骼 X线片出现不规则钙化线（C错）。后遗症期：多见于2岁以后儿童。因婴幼儿期重症佝偻病可残留不同程度的骨骼畸形。临床症状消失，血生化和X线摄片正常（D错）。